关于细菌质粒的描述中，错误的是
A. 可在细菌间互相转移
B. 可作为遗传物质传给子代细菌
C. 为细菌生命活动必需的遗传物质
D. 为细菌染色体外的环状双股DNA
E. 携带有某些决定细菌生物学性状的基因

正确答案：C。为细菌生命活动必需的遗传物质